患者，男，50岁。反复浮肿，尿血3年，经常感冒。症见面色无华，少气乏力，午后低热，口干咽燥，舌红少苔，脉细。查体：血压140/95mmHg，尿蛋白（﹢﹢），24小时尿蛋白定量3g，内生肌酐清除率48%。血尿素氮10mmol/L。除对症治疗外，还应加用
A. 参芪地黄汤
B. 六味地黄汤
C. 右归丸
D. 左归饮
E. 大补元煎

正确答案：A。参芪地黄汤

解析：患者查体发现血压140/95mmHg，尿蛋白（﹢﹢），24小时尿蛋白定量3g，内生肌酐清除率48%，血尿素氮10mmol/L，可诊断为慢性肾小球肾炎；气虚不能上承于面，则面色无华；气虚则少气乏力；阴虚不能制阳则生内热，午后低热；阴虚不能滋润故口干咽燥；舌红少苔，脉细，均为气阴两虚的表现，治法为益气养阴，方药选用参芪地黄汤加减（A对）。六味地黄汤（B错）滋养肝肾，用于治疗肝肾阴虚证。右归丸（C错）温补肾阳，填精益髓，用于治疗肾阳不足，命门火衰证。左归饮（D错）滋阴补肾，填精益髓，用于治疗真阴不足证。大补元煎（E错）救本培元，大补气血，用于治疗气血大亏，精神失守等危剧病症。